常用什么表示病程长的慢性病存在或流行的程度
A. 发病率
B. 患病率
C. 某病病死率
D. 某病死亡率
E. 治愈率

正确答案：B。患病率